1967年，Tolonen对粘纤厂接触CS₂的333名工人及造纸厂333名无CS₂接触的工人进行调查并随访5年，其中接触CS₂工人中心肌梗塞发生25例，无CS2接触工人有7例发生心肌梗死。AR为
A. 0.05
B. 0.12
C. 0.18
D. 0.92
E. 2.57

正确答案：A。0.05

解析：本题考查归因危险度的计算。归因危险度（AR），是暴露组发病率与对照组发病率相差的绝对值。题中归因危险度＝25/333－7/333＝0.05（A对BCDE错）。